女，65岁。腹胀伴食欲不振半年余。查体：腹部膨隆，移动性浊音（+）。妇科检查：宫颈光滑，盆底可触及多个质硬结节。左侧附件区可触及包块，约6cm×5cm大小，呈囊实性，界限不清。该患者手术后首选的治疗是
A. 生物治疗
B. 内分泌治疗
C. 抗结核治疗
D. 化学药物治疗
E. 放射治疗

正确答案：D。化学药物治疗

解析：该患者为老年女性，腹胀伴食欲不振半年余（卵巢恶性肿瘤早期常无症状，晚期主要症状为腹胀、腹部肿块、腹腔积液及其他消化道症状），腹部膨隆，移动性浊音（+）（常伴腹腔积液）。妇检：宫颈光滑，盆底可触及多个质硬结节。左侧附件区可触及包块，约6cm×5cm大小，呈囊实性，界限不清（三合诊检查可在直肠子宫陷凹处触及质硬结节或肿块，肿块多为双侧，实性或囊实性，表面凹凸不平，活动差，与子宫分界不清），检查结果示CA125 1260U/ml（80%卵巢上皮性癌患者血清CA125水平升高），最可能的诊断是卵巢上皮性癌。该患者手术后首选的治疗是化学药物治疗（D对），因其对化疗较敏感，即使已有广泛转移也能取得一定疗效。除经过全面分期手术的ⅠA期和ⅠB期且为G1（高分化）的患者不需化疗外，其他患者均需化疗。生物治疗（A错）、放射治疗（E错）对卵巢上皮性癌的治疗价值有限。内分泌治疗（B错）不用于卵巢上皮癌的治疗。抗结核治疗（C错）对生殖器结核有效，对卵巢上皮癌无效。